男，55岁。进行性吞咽困难三个月，体重下降5kg，目前能进半流食。该患者食管吞钡检查不会出现的描述是
A. 食管呈鸟嘴样改变
B. 食管充盈缺损
C. 食管管壁僵硬
D. 龛影
E. 食管粘膜断裂

正确答案：A。食管呈鸟嘴样改变

解析：中年男性患者，进行性吞咽困难，3个月体重下降5kg（提示恶病质），结合患者病史和临床表现，对该病人最可能的诊断为食管癌。食管癌的钡剂造影典型表现为食管黏膜断裂（E对）、管壁僵硬（C对）、食管充盈缺损（B对）和龛影（D对）。食管呈鸟嘴样改变（A错，为本题正确答案）为贲门失弛缓症的食管吞钡X线片表现。